多形性渗出性红斑的基本病理表现是
A. 棘层内疱
B. 基层下疱
C. 角化不良
D. 异常增生
E. 棘层松解

正确答案：B。基层下疱

解析：基层下疱：疱在基底层之下，基底细胞变性，使上皮全层与固有层分离。见于黏膜良性类天疱疮、多形渗出性红斑。掌握“口腔黏膜基本病理变化”知识点。